男，65岁。急性广泛前壁心肌梗死4天，突发喘憋2小时。查体血压90/60mmHg，双肺未闻及干湿性啰音，心率105次/分，律齐，胸骨左缘第4肋间可闻及响亮的收缩期杂音伴震颤。该患者喘憋最可能的原因是
A. 支气管哮喘
B. 心房颤动
C. 感染性心内膜炎
D. 室间隔穿孔
E. 肺炎

正确答案：D。室间隔穿孔

解析：中老年男性，急性广泛前壁心肌梗死4天，突发喘憋2小时（急性心肌梗死1周内突发喘憋，多由急性心肌梗死并发症引起）。胸骨左缘第4肋间可闻及响亮的收缩期杂音伴震颤（此为急性心肌梗死并发室间隔穿孔（D对）的典型特点）。支气管哮喘（P29）（A错）双肺可闻及广泛哮鸣音，但并不会出现心脏杂音。心房颤动（B错）（P188）心律绝对不齐，而病例中患者律齐。感染性心内膜炎（P309）（C错）常引起主动脉瓣关闭不全，可在主动脉瓣区闻及柔和、短促的舒张期杂音，与患者心脏杂音不符。肺炎（P42）（E错）常有发热，咳嗽咳痰，肺部可闻及湿性啰音，但并无心脏杂音。